拔牙创内形成正常血凝块的意义是
A. 防止出血
B. 保护创口
C. 防止感染
D. 促进创口愈合
E. 以上意义均对

正确答案：E。以上意义均对

解析：本题考查拔牙创内形成正常血凝块的意义。拔牙后即刻，挖匙去除牙槽窝异物、炎性肉芽组织或根端小囊肿后，搔刮并由于拔牙后根尖血管和牙周组织的撕裂出现新鲜血液，15～30min后出血停止，此时形成正常血凝块具有重要意义：防止出血（A对）、保护创口（B对）、防止感染（C对）、促进创口愈合（D对）。如血块脱落、形成不良或无血块形成，则创口愈合缓慢，出现牙槽感染、疼痛等的并发症的可能性大大增加（ABCD均对，故E为本题的正确答案）。